女贞子的功效是
A. 滋补肝肾，益气
B. 滋阴益肾，利尿
C. 滋阴润肺，清虚热
D. 滋肾补阴，明目乌发
E. 滋阴潜阳，软坚散结

正确答案：D。滋肾补阴，明目乌发

解析：本题考查的是女贞子的功效。女贞子的功效是滋肾补阴，明目乌发（D对）。女贞子：【功效】滋肾补肝，清虚热，明目乌发。楮实子：【功效】滋阴益肾，清肝明目，利尿（B错）。鳖甲：【功效】滋阴潜阳，退热除蒸，软坚散结（E错）。功效为滋补肝肾，益气（A错）或滋阴润肺，清虚热（C错）的中药，2022年考试指南未明确说明。